胃壁的构造
A. 胃壁从内向外分3层
B. 胃小弯处粘膜皱襞间的纵沟称胃道
C. 贲门处粘膜突起形成贲门瓣
D. 肌层分为外纵、中斜、内环3层
E. 外层的纵行肌仅在胃大弯处发达

正确答案：B。胃小弯处粘膜皱襞间的纵沟称胃道

解析：胃壁从内向外分4层(A错)，胃小弯处黏膜皱襞间的纵沟称胃道(B对)，贲门处无粘膜突起，只有幽门处突起为幽门瓣(C错)，肌层分为外纵、中环、内斜3层(D错)，纵行肌在胃大弯和胃小弯处均发达(E错)。